一腹壁静脉曲张患者，脐以上血流方向由下至上，脐以下血流由上至下。患者应考虑为
A. 上腔静脉阻塞
B. 下腔静脉阻塞
C. 门静脉高压或门静脉阻塞
D. 髂内静脉阻塞
E. 髂外静脉阻塞

正确答案：C。门静脉高压或门静脉阻塞

解析：门静脉高压或门静脉阻塞（C对）时，为了让循环通畅，门静脉开通与腔静脉的交通吻合支，脐上静脉向上汇合，进入上腔静脉；脐下静脉向下汇合，进入下腔静脉。上腔静脉阻塞（A错）时上腹壁的浅静脉曲张血流方向均转流向下；下腔静脉阻塞（B错）时，脐以下的腹壁浅静脉血流方向均转流向上。髂内静脉阻塞（D错）、髂外静脉阻塞（E错）不会导致此种症状。